四逆汤与四逆散二方组成中均含有的药物是
A. 柴胡
B. 枳实
C. 干姜
D. 芍药
E. 甘草

正确答案：E。甘草

解析：本题考查方剂的组成，四逆汤组成甘草、干姜、附子。四逆散组成甘草、枳实、柴胡、芍药。四逆汤与四逆散二方组成中均含有的药物是甘草（E对）。